艾滋病病毒侵入人体后可分为的病期是
A. Ⅱ期
B. Ⅲ期
C. Ⅳ期
D. Ⅴ期
E. Ⅵ期

正确答案：B。Ⅲ期

解析：从初始感染HIV到终末期是一个漫长且复杂的过程，在不同阶段，HIV相关的临床表现也复杂多变。艾滋病全过程分为急性期、无症状HIV感染期和艾滋病期Ⅲ期（B对）。急性期为HIV感染进入人体内24～38小时；无症状HIV感染期持续时间为6～8年；艾滋病期为感染HIV后的最终阶段。